男性，50岁，吸烟史30年，刺激性咳嗽，痰中带血丝3周，胸片显示右肺门处阴影增大，纵膈增宽，上叶不张，进一步检查是
A. 结核菌素试验
B. 痰细胞学检查
C. 支气管镜检查
D. 痰培养加药敏试验
E. 经胸壁穿剌活组织检查

正确答案：C。支气管镜检查

解析：中年男性患者，吸烟史30年（引起肺癌最常见的原因），刺激性咳嗽，痰中带血丝3周（肺癌的典型表现），胸片显示右肺门处阴影增大（提示中央型肺癌），纵膈增宽，上叶不张，根据患者的临床症状、体征及实验室检查，考虑最可能的诊断为中央型肺癌，所以进一步检查是支气管镜检查（C对），支气管镜是诊断肺癌的主要方法之一，对于中央型肺癌的诊断阳性率可达90%左右。结核菌素试验（A错）主要用于结核的诊断。痰细胞学检查（B错）必须获得气道深部的痰液，及时送检，至少送检3次以上。敏感性<70%，但特异性高。痰培养加药敏试验（D错）主要用于肺炎治疗时药物的选用。经胸壁穿剌活组织检查（E错）适用于紧贴胸壁或离胸壁较近的肺内病灶，该患者的病灶位于肺门处。